关于生长发育的一般规律的错误论述是
A. 生长发育过程是一个连续性过程
B. 生长发育过程具有阶段性
C. 各系统的发育过程平稳而协调
D. 生长发育速度呈波浪性
E. 儿童个体生长发育呈现出一定的轨迹现象

正确答案：C。各系统的发育过程平稳而协调

解析：各系统、器官的生长发育不平衡：小儿各系统的发育快慢不同，各有先后。如神经系统发育是先快后慢，生殖系统发育是先慢后快，体格发育是快慢快，淋巴系统发育在儿童期较迅速，青春期达高峰，以后降至成人水平。掌握“小儿生长发育规律”知识点。